女，60岁，颈部肿块4月，生长快，无疼痛，查体发现甲状腺右叶直径3cm的肿块，质硬，边界不清，吞咽时活动度小。如术中冰冻切片报告为良性肿瘤，而行患侧甲状腺大部切除，术后石蜡切片报告为甲状腺乳头状癌，下一步的治疗首选
A. 外放射治疗
B. 重新手术，行甲状腺患侧峡部全切，对侧大部切除术
C. 放射性131碘治疗
D. 口服甲状腺干制剂治疗
E. 化疗

正确答案：B。重新手术，行甲状腺患侧峡部全切，对侧大部切除术

解析：甲状腺癌手术治疗过程中，因良性病变行腺叶切除，术后病理证实为分化型甲状腺癌者，若切缘阴性、对侧正常、肿块直径小于1cm，可继续观察；否则，需再行手术。此题中患者肿块直径为3cm，大于1cm，须再次实施手术。甲状腺肿瘤常用术式包括：①腺叶次全切：适用于诊断为良性疾病，但术后病理诊断为孤立性乳头状癌者；②腺叶+峡部切除：适用于肿瘤直径不大于1.5cm，且局限于一叶者；③甲状腺近全切：适用于肿瘤直径大于1.5cm，一侧乳头状癌伴有颈淋巴结转移者；④甲状腺全切：适用于高度侵袭性乳头状癌、滤泡状癌，明显多灶性，双侧颈淋巴结肿大，肿瘤侵犯颈部组织或有远处转移者；⑤甲状腺全切+患侧颈淋巴结清扫，可用于治疗已有远处转移者。该患者肿瘤直径3cm，需行甲状腺近全切术，即甲状腺患侧、峡部全切，对侧大部切除术（B对）。外放射治疗（A错）多用于治疗未分化癌。放射性¹³¹I治疗（C错）可作为甲状腺全切术后的辅助治疗，可清楚术后残留甲状腺组织和治疗甲状腺癌转移灶。口服甲状腺干制剂治疗（D错）可作为甲状腺次全切或全切术后的辅助治疗，通过抑制垂体分泌TSH，减少肿瘤复发。甲状腺癌对化疗（E错）不敏感。